板蓝根的药材性状特征主要有
A. 呈圆柱形，稍扭曲
B. 根头略膨大，可见暗绿色或暗棕色轮状排列的叶柄残基
C. 表面淡灰黄色或淡棕黄色，有纵皱纹
D. 质坚硬，断面强纤维性
E. 气微，味微甜后苦涩

正确答案：A、B、C、E。呈圆柱形，稍扭曲；根头略膨大，可见暗绿色或暗棕色轮状排列的叶柄残基；表面淡灰黄色或淡棕黄色，有纵皱纹；气微，味微甜后苦涩

解析：本题考查的是板蓝根药材的性状鉴别。板蓝根的药材性状特征主要有呈圆柱形，稍扭曲（A对）、根头略膨大，可见暗绿色或暗棕色轮状排列的叶柄残基（B对）、表面淡灰黄色或淡棕黄色，有纵皱纹（C对）与气微，味微甜后苦涩（E对）。板蓝根：【性状鉴别】药材呈圆柱形，稍扭曲。表面淡灰黄色或淡棕黄色，有纵皱纹、横长皮孔样突起及支根痕。根头略膨大，可见暗绿色或暗棕色轮状排列的叶柄残基和密集的疣状突起。体实，质略软，断面皮部黄白色，木部黄色。气微，味微甜后苦涩。质坚硬，断面强纤维性（D错）为黄芪的性状特征。黄芪：【性状鉴别】药材呈圆柱形，有的有分枝，上端较粗。表面淡棕黄色或淡棕褐色，有不整齐的纵皱纹或纵沟。质硬而韧，不易折断，断面纤维性强，并显粉性，皮部黄白色，木部淡黄色，具放射状纹理及裂隙。老根中心偶呈枯朽状，黑褐色或呈空洞。气微，味微甜，嚼之微有豆腥味。